目前我国发展社区卫生服务的基本原则描述最恰当的是
A. 以政府为中心
B. 经济效益为中心
C. 疾病治疗为中心
D. 以市场化为主导
E. 以区域卫生规划为指导

正确答案：E。以区域卫生规划为指导

解析：目前我国发展社区卫生服务的基本原则为：1.坚持社区卫生服务的公益性质，注重卫生服务的公平、效率和可及性：2.坚持政府主导，鼓励社会参与，多渠道发展社区卫生服务：3.坚持实行区域卫生规划，立足调整和利用现有卫生资源、辅以改扩建和新建，健全社区卫生服务网络：4.坚持预防为主，公共卫生和基本医疗并重，中西医并重，防治结合综合服务：5.坚持以地方为主，因地制宜，探索创新，积极推进。基本原则中没有提及经济效益为中心（B错）、疾病治疗为中心（C错）、以市场化为主导（D错），有提及坚持政府主导，但不是以政府为中心（A错），有提及坚持实行区域卫生计划，因此，以区域卫生规划为指导描述最恰当（E对）。